吲哚美辛作为非处方药用于解热时，只能使用的剂型是
A. 片剂
B. 栓剂
C. 胶囊剂
D. 注射剂
E. 贴剂

正确答案：C。胶囊剂